关于散剂的叙述，正确的是
A. 剂量在0.01g以下的毒性药物，应配制成1：10倍散
B. 处方中两种以上药物混合时若出现液化现象，则均应先制成低共熔物，再与其他固体粉末混匀
C. 含挥发油组分的散剂制备时，应加热处理，以便混匀
D. 含毒剧药或贵重细料药的散剂分剂量常采用估分法
E. 当药物比例相差悬殊时，应采用等量递增法混合

正确答案：E。当药物比例相差悬殊时，应采用等量递增法混合